既平肝阳，又降胃气的药是
A. 磁石
B. 珍珠
C. 枇杷叶
D. 代赭石
E. 珍珠母

正确答案：D。代赭石

解析：本题考查的是赭石的性能特点。既平肝阳，又降胃气的药是代赭石（D对）。代赭石即赭石。赭石：【性能特点】本品质重镇潜，苦寒清降。入肝经，善镇潜平肝，治肝阳上亢。入肺、胃经，善降肺胃之逆，治呕呃喘息。入心经，善凉血止血，治血热气逆之吐衄。磁石（A错）：【性能特点】本品咸寒质重，沉降下行，镇坠与补益并举。入肝、心经，善镇惊安神、平肝潜阳，治心悸失眠、阳亢眩晕。入肾经，能益肾而聪耳明目、纳气平喘，治肾虚耳鸣、耳聋、目昏、喘促。珍珠（B错）：【性能特点】本品介类重镇兼涩，甘寒清解兼补，入心、肝经。既镇心而安神定惊，治惊悸、失眠、癫痫及惊风；又清肝而明目除翳，治目赤翳障；还解毒敛疮、润肤祛斑，治喉痹口疮、溃疡不敛、皮肤色斑。枇杷叶（C错）：【性能特点】本品苦泄降，微寒清，入肺、胃经。既清肺胃之热，又降肺胃之气，治肺热咳喘、胃热呕哕皆宜。珍珠母（E错）：【性能特点】本品介类质重镇潜，咸寒清泄兼补，入心、肝经，生用、煅用功异。生用善镇潜肝阳、清肝明目、安神定惊，治阳亢头痛眩晕、肝火目赤肿痛、惊悸失眠；煅用能收湿敛疮，治湿疮、湿疹。